对研究所需指标或数据进行测定或测量产生的偏倚为
A. 诊断怀疑偏倚
B. 测量偏倚
C. 暴露怀疑偏倚
D. 易感性偏倚

正确答案：B。测量偏倚

解析：本题考查测量偏倚。对研究所需指标或数据进行测定或测量产生的偏倚为测量偏倚（B对ACD错）。测量偏倚是在收集整理信息过程中由于测量暴露与结局的方法有缺陷造成的系统误差。